患者，女，35岁。黄疸贫血伴关节酸痛3个月，体检检查巩膜黄染，脾肋下2cm，血红蛋白58g/L，白细胞5×10⁹/L，网织红细胞计数25%，外周血涂片成熟红细胞形态正常，尿隐血试验阴性。最可能的诊断是
A. 急性白血病
B. 急性黄疸型肝炎
C. 肝癌骨髄转移
D. 溶血性贫血
E. 风湿性关节炎

正确答案：D。溶血性贫血

解析：患者中青年女性，黄疸、贫血伴关节酸痛3个月，查体：巩膜黄染，脾肿大（溶血性贫血的表现），血常规：血红蛋白58g/L（成年女性正常110～150g/L），白细胞5×10⁹/L（正常值4～10×10⁹/L），网织红细胞计数25%（正常值0.005～0.015）提示骨髓红系代偿性增生（符合溶血性贫血的变化），外周血涂片成熟红细胞形态正常，故考虑诊断为溶血性贫血（D对）可能性大。急性白血病（P568）（A错）为造血干祖细胞的恶性克隆性疾病，骨髓中大量白血病细胞增生，正常造血功能受抑，表现为贫血、出血、感染和浸润征象，可有肝脾肿大，一般无黄疸，无骨髓红系代偿性增加的表现，白细胞常增多，血涂片可见数量不等的原始和幼稚细胞；急性黄疸型肝炎（B错）的临床表现以黄疸和消化道症状为主，可见乏力、纳差、恶心、腹胀、发热，可有肝脏肿大，仅少数患者有脾脏肿大，无关节痛、网织红细胞计数增加；肝癌骨髄转移（C错）临床表现以肝区疼痛、肝大、黄疸、骨痛、发热、消瘦、贫血、出血等表现为主，一般无脾肿大、网织红细胞计数增加；风湿性关节炎（P805）（E错）临床表现以游走性、多发性关节炎为主，反复发作，与天气变化有关，一般无贫血、黄疸、脾肿大。